慢性轻度铅中毒患者的处理原则是
A. 驱铅治疗，调离铅作业
B. 驱铅治疗后一般不必调离铅作业
C. 积极治疗，必须调离
D. 密切观察
E. 对症处理

正确答案：B。驱铅治疗后一般不必调离铅作业

解析：慢性轻度铅中毒患者的处理原则是驱铅治疗后一般不必调离铅作业（B对）。根据《职业性慢性铅中毒诊断标准（GBZ37-2002）》劳动能力鉴定，慢性轻度铅中毒患者的处理原则是驱铅治疗后一般不必调离铅作业（B对DE错）。铅吸收时可继续原工作，3～6月复查一次。慢性中度中毒时驱铅治疗后原则上调离铅作业（A错）。慢性重度中毒时必须调离铅作业，并根据病情给予治疗和休息（C错）。